下列属于现代医学目的的是
A. 重治疗轻预防
B. 提高生命质量
C. 过度追求技术发展
D. 克服疾病
E. 避免死亡

正确答案：B。提高生命质量

解析：该题属于记忆性题目。重治疗轻预防，过度追求技术发展的说法本身就不正确（A错），避免死亡也是错误的，生老病死是人之常情，不应刻意而为之（E错）。而克服疾病这个说法有些绝对，临床上有很大一部分病是没有克服办法的（D错）。现代医学的主要目的是要提高生命质量（B对）。